原发性肺结核基本病变表现为
A. 渗出、坏死与纤维化
B. 渗出、增殖与纤维化
C. 纤维化、增殖与坏死
D. 渗出、增殖与坏死
E. 渗出、纤维化与坏死

正确答案：D。渗出、增殖与坏死